男，38岁，间歇性浮肿10余年，伴恶心呕1周。血压155/110mmHg。血常规Hb80g/L。尿常规：尿蛋白（++），颗粒管型2～3个/HP。血Scr485umnol/L。上例患者肾功能损害分期为
A. 肾功能正常期
B. 肾功能不全代偿期
C. 肾功能不全氮质血症期
D. 肾功能衰竭期
E. 尿毒症晚期

正确答案：D。肾功能衰竭期

解析：该患者已诊断为慢性肾衰竭，根据我国慢性肾衰竭的分期方法显示：肾功能代偿期血肌酐137～177umol/L，肾功能失代偿期血肌酐186～442umol/L，肾功能衰竭期血肌酐451～707umol/L，尿毒症期血肌酐≥707umol/L。该患者血肌酐为485umol/L，肾功能损害分期为肾功能衰竭期（D对）。